肉瘤多见于
A. 婴幼儿
B. 中年人
C. 青壮年
D. 老年人
E. 消瘦体弱的人

正确答案：C。青壮年

解析：肉瘤多见于青壮年。掌握“肉瘤”知识点。